下列何种治疗为对因治疗
A. 强心苷治疗心瓣膜引起的心力衰竭
B. 氢氯噻嗪治疗水肿
C. 青霉素治疗肺炎球菌性肺炎
D. 氯喹治疗疟疾
E. 碳酸氢钠治疗消化性溃疡

正确答案：C、D。青霉素治疗肺炎球菌性肺炎；氯喹治疗疟疾